队列研究中，暴露队列的成员必须
A. 有相同的暴露史
B. 有相同性别
C. 同年出生
D. 经历过同样的时期
E. 居住在同一地区

正确答案：A。有相同的暴露史

解析：本题考查队列研究成员特点。队列表示一个特定的研究人群，具有某种共同暴露或特征的一组人群，可称为某暴露队列。因此，队列研究中成员必须有相同的暴露史（A对BCDE错），才能满足被观察群体之间的可比性。